心肌梗死最常发生的部位在
A. 室间隔后1/3
B. 左心室后壁
C. 右心室前壁
D. 左心室前壁
E. 左心室侧壁

正确答案：D。左心室前壁

解析：约50%的心肌梗死（MI）发生于左冠状动脉前降支的供血区，如左心室前壁（D对）、心尖部及室间隔前2/3；约25%的MI发生于右冠状动脉的供血区，如左心室后壁（B错）、室间隔后1/3（A错）及右心室。右心室（C错）和心房发生MI者较少见。